乳牙牙根生理性吸收时，冠髓尚属正常，根管的牙髓细胞变性，消失的时期是
A. 牙根完全吸收时
B. 牙根开始吸收时
C. 牙根吸收1/2
D. 牙根吸收1/4
E. 牙根吸收3/4

正确答案：C。牙根吸收1/2

解析：本题考查乳牙牙根的生理性吸收。乳牙牙根生理性吸收时，冠髓尚属正常，根管的牙髓细胞变性，消失的时期是牙根吸收1/2（C对）。乳牙牙根有生理性吸收的特点。牙根吸收的初期，牙髓尚维持正常结构。牙根吸收达1/4时（D错），冠髓无变化，根髓尚属正常，但在吸收面处纤维组织增加，近吸收面处成牙本质细胞排列混乱及扁平化。牙根吸收达1/2时，冠髓尚属正常，根髓近吸收面处，牙髓细胞减少，纤维增多，成牙本质细胞变性、消失，且牙本质内壁有吸收窝。牙根吸收达3/4时（E错），正常牙髓细胞减少，成牙本质细胞广泛萎缩、消失，纤维细胞增加，毛细血管新生，神经纤维渐渐消失，并有进行性内吸收。乳牙脱落时期，残存牙髓失去正常组织形态，无正常牙髓细胞、肉芽变性，牙冠的牙本质发生内吸收。